肠系膜根
A. 为空、回、结肠系膜附着于腹后壁的部分
B. 起自第1腰椎左侧
C. 斜向右下跨过脊柱及其前方结构
D. 长约20cm
E. 止于左骶髂关节前方

正确答案：C。斜向右下跨过脊柱及其前方结构

解析：肠系膜根为空、回肠系膜附着于腹后壁的部分(A错)，起自第2腰椎左侧(B错)，斜向右下跨过脊柱及其前方结构(C对)，长约15cm(D错)，止于右骶髂关节前方(E错)。